普通药品处方保留
A. 3个月
B. 6个月
C. 1年
D. 2年
E. 3年

正确答案：C。1年

解析：本题考查处方保留期限。处方由调剂处方药品的医疗机构妥善保存。普通处方、急诊处方、儿科处方保存期限为1年（C对），医疗用毒性药品、第二类精神药品处方保存期限为2年（D错），麻醉药品和第一类精神药品处方保存期限为3年（E错）。处方保存期满后，经医疗机构主要负责人批准、登记备案，方可销毁。